关于气雾剂类型的说法，错误的是
A. 按给药定量与否，气雾剂可分为定量和非定量气雾剂
B. 按给药途径，气雾剂可分为吸入、非吸入
C. 溶液型气雾剂属于二相气雾剂
D. 乳浊液型气雾剂属于三相气雾剂
E. 混悬液型气雾剂属于四相气雾剂

正确答案：E。混悬液型气雾剂属于四相气雾剂

解析：本题考查的是气雾剂的类型。混悬液型气雾剂属于三相气雾剂（E错，为本题正确答案）。气雾剂的分类：①按用药途径，气雾剂可分为吸入气雾剂、非吸入气雾剂（B对）。②按处方组成，气雾剂可分为二相气雾剂（气相和液相）和三相气雾剂（气相、液相、固相或液相）。溶液型气雾剂属于二相气雾剂（C对），乳浊液和混悬液型气雾剂属于三相气雾剂（D对）。③按给药定量与否，气雾剂可分为定量气雾剂和非定量气雾剂（A对）。